南沙参的性状特征是
A. 表面淡灰绿色或者淡棕黄色，有纵皱纹
B. 表面灰褐色或棕褐色，有数个圆形空洞的茎基痕
C. 断面黄白色或类白色，有多数不规则裂隙，呈花纹状
D. 细长圆柱形，断面皮部黄白色，木部黄色
E. 断面灰白色，皮部散有棕色油点，形成层成环

正确答案：C。断面黄白色或类白色，有多数不规则裂隙，呈花纹状

解析：本题考查的是南沙参药材的性状鉴别。南沙参的性状特征是断面黄白色或类白色（D错），有多数不规则裂隙，呈花纹状（C对）。南沙参：【性状鉴别】药材呈圆锥形或圆柱形，略弯曲。表面黄白色或淡棕黄色（AB错），凹陷处常有残留粗皮，上部多有深陷横纹，呈断续的环纹，下部有纵纹及纵沟。顶端具1或2个根茎。体轻，质松泡，易折断，断面不平坦，黄白色（E错），多裂隙。气微，味微甘。